在临床试验中，避免主观偏倚的最主要方法是
A. 统一检测标准
B. 由一个人完成所有的结果观察
C. 盲法
D. 只使用客观指标
E. 随机抽样

正确答案：C。盲法

解析：本题考查盲法的作用。实验流行病学研究中常常因研究对象和研究者本人、实验设计阶段、资料收集或分析阶段出现选择偏倚和信息偏倚等。为避免以上偏倚的出现可采用盲法（C对ABDE错）进行控制。